男婴，足月顺产，22天。出生体重3100g，生后母乳喂养，第3天出现皮肤黄染，至今黄疸不退。胃纳好，体温正常。体检：体重3750g，除皮肤黄染外，无其他异常。血常规及尿常规均正常，血清胆红素205μmol/L。如何处理
A. 血培养
B. 测G-6-P活性
C. 暂停母乳喂养
D. 网织红细胞计数
E. 以上都不是

正确答案：C。暂停母乳喂养